可摘局部义齿基托与天然牙的接触关系，不正确的是
A. 基托对天然牙无压力
B. 应进入基牙邻面倒凹区，可增强固位
C. 近龈缘处基托要做缓冲
D. 前牙区基托边缘在舌隆突上
E. 舌腭侧基托边缘与天然牙轴面非倒凹区接触

正确答案：B。应进入基牙邻面倒凹区，可增强固位

解析：基托与天然牙的关系：基托应与余留天然牙邻面和舌面的非倒凹区之间密合而无间隙，既有利于义齿的固位和稳定，又能避免食物嵌塞。基托不应进入基牙邻面和余留牙舌面的倒凹区，以免造成义齿摘戴困难。前牙区腭（舌）侧基托边缘应远离前牙舌侧龈缘，或者位于舌隆突上，并与之密合。掌握“局部义齿人工牙及基托”知识点。